组成小青龙颗粒处方的药物，除麻黄、桂枝、干姜、细辛外，还有
A. 白术
B. 白芍
C. 五味子
D. 炙甘草
E. 法半夏

正确答案：B、C、D、E。白芍；五味子；炙甘草；法半夏

解析：本题考查的是小青龙颗粒的药物组成。组成小青龙颗粒处方的药物，除麻黄、桂枝、干姜、细辛外，还有白芍（B对）、五味子（C对）、炙甘草（D对）与法半夏（E对）。小青龙颗粒：【药物组成】麻黄、桂枝、干姜、细辛、五味子、白芍、法半夏、甘草（炙）。